碱性酒石酸铜试液反应所鉴别的药物是
A. 葡萄糖
B. 磺胺嘧啶
C. 硫酸阿托品
D. 奥沙西泮
E. 丙磺舒

正确答案：A。葡萄糖

解析：本题考查常用的药品鉴别方法。葡萄糖（A对）可与碱性酒石酸铜试液生成氧化亚铜红色沉淀，用来鉴别葡萄糖。磺胺嘧啶（B错）及水解后的奥沙西泮（D错）含有芳伯氨基，均可用重氮化反应来进行鉴别。硫酸阿托品（C错）可发生托烷类生物碱的Vitali反应，即与硝酸共热后在醇制氢氧化钾溶液中显深紫色，用于鉴别。丙磺舒（E错）含有羧基，可与三氯化铁反应产生有色沉淀，用于鉴别。